对生理过程进行替代和调节的医疗器械是
A. 心电图机
B. 避孕器具
C. 手动轮椅
D. 手术器械
E. 心脏瓣膜

正确答案：E。心脏瓣膜